下列细菌中不引起特异性感染的是
A. 破伤风杆菌
B. 结核菌
C. 梅毒螺旋体
D. 放线菌
E. 大肠杆菌

正确答案：E。大肠杆菌

解析：口腔颌面部感染可分为化脓性和特异性两大类，后者指结核、梅毒、放线菌等引起的特定病变。掌握“颌面部骨结核、放线菌病”知识点。